可致超敏反应综合征（AHS），推荐用药前做HLA-B*5801基因筛查的抗痛风药物是
A. 苯溴马隆
B. 别嘌醇
C. 秋水仙碱
D. 非布司他
E. 丙磺舒

正确答案：B。别嘌醇

解析：本题考查别嘌醇的不良反应。别嘌醇（B对）可致超敏反应综合征（AHS），推荐应用前做基因（HLA-B*5801）筛查。